根据《医疗用毒性药品管理办法》，下列关于医疗用毒性药品的说法，错误的是
A. 毒性药品的收购和经营，由药品监督管理部门指定的药品经营企业承担
B. 药品零售企业调配毒性药品时，每次处方剂量不得超过二日极量
C. 麦角胺和洋地黄毒苷为医疗用毒性药品
D. 调配处方时，对处方未注明“生用”的毒性中药，应当付炮制品

正确答案：C。麦角胺和洋地黄毒苷为医疗用毒性药品

解析：本题考查医疗用毒性药品。麦角胺属于药品类易制毒化学品（C错，为本题正确答案）。目前，药品类易制毒化学品分为两类，即：麦角酸和麻黄素等物质。药品类易制毒化学品品种目录（2010版）所列物质有：（1）麦角酸；（2）麦角胺；（3）麦角新碱；（4）麻黄素、伪麻黄素、消旋麻黄素、去甲麻黄素、甲基麻黄素、麻黄浸膏、麻黄浸膏粉等麻黄素类物质。（麻黄素也称为麻黄碱）。毒性药品的收购和经营，由药品监督管理部门指定的药品经营企业承担（A对），其他任何单位或者个人均不得从事毒性药品的收购、经营业务。零售药店供应和调配毒性药品，凭盖有医生所在的医疗单位公章的正式处方。每次处方剂量不得超过二日极量（B对）。医疗机构供应和调配毒性药品，须凭执业医师签名的正式处方。调配处方时，必须认真负责，计量准确，按医嘱注明要求，并由配方人员及具有药师以上技术职称的复核人员签名盖章后方可发出。对处方未注明“生用”的毒性中药，应当付炮制品（D对）。如发现处方有疑问时，须经原处方医生重新审定后再行调配。处方一次有效，取药后处方保存2年备查。